脊神经的4支中，不含有下列哪一支
A. 脊膜支
B. 外侧皮支
C. 交通支
D. 后支
E. 前支

正确答案：B。外侧皮支

解析：脊神经的4支包括前支（E错）、后支（D错）、交通支（C错）、脊膜支（A错）。外侧皮支（B对）不属于脊神经的分支。